输胆管道，不包括
A. 胆囊管
B. 肝左管
C. 肝右管
D. 肝总管
E. 胆总管

正确答案：A。胆囊管

解析：输胆管道包括肝左管(B对)、肝右管(C对)、肝总管(D对)和胆总管(E对)，胆囊里包括胆囊管(A错，为本题正确答案)，和输胆管道共同组成肝外胆道系统。